患者，女，18岁。2周前患扁桃体炎，近日心悸，气短，发热，出汗。踝、膝关节游走性疼痛。查体：心率110次/分，第1心音减弱，上肢内侧皮肤有环形红斑。应首先考虑的是
A. 病毒性心肌炎
B. 类风湿性关节炎
C. 风湿热
D. 亚急性感染性心内膜炎
E. 系统性红斑狼疮

正确答案：C。风湿热

解析：本例患者发病前患扁桃体炎，为上呼吸道A组乙型溶血性链球菌感染感染表现，心悸，气短，发热，出汗，心率110次/分，第1心音减弱，提示心脏损害，心脏炎可能；踝、膝关节游走性疼痛提示关节炎，加之上肢内侧皮肤有环形红斑为风湿热的典型表现，故应首先考虑的是风湿热（C对）。病毒性心肌炎（A错）发病前亦可有呼吸道的前驱感染病史、心率改变及第1心音减弱等表现，但无踝、膝关节游走性疼痛等关节炎表现及风湿热的典型环形红斑表现。类风湿性关节炎（B错）主要表现为小关节滑膜所致的关节肿痛，受累关节晨僵、疼痛、压痛、肿胀及活动受限，初呈游走性，以后固定，本例患者主要受累关节为踝、膝等大关节，故不考虑类风湿性关节炎可能。亚急性感染性心内膜炎（D错）多发生在器质性心脏病基础上，病前亦可有上呼吸道感染史，主要表现为不规则低中度发热、进行性贫血、乏力、肝脾肿大，杵状指（趾）、关节痛，与本例患者临床表现不符。系统性红斑狼疮（E错）亦可出现关节炎及心脏受累症状，但其特异性皮损为蝶形红斑、亚急性皮肤红斑狼疮、盘状红斑，而非环形红斑。